八正合剂处方的君药是
A. 川木通、滑石
B. 灯心草、瞿麦
C. 川木通、大黄
D. 瞿麦、炒车前子
E. 川木通、炒车前子

正确答案：E。川木通、炒车前子

解析：本题考查的是八正合剂的方义简释。八正合剂处方的君药是川木通、炒车前子（E对）。八正合剂：【方义简释】方中川木通淡渗寒清，微苦能泄，善清心火、利湿热、通经脉而利尿通淋；炒车前子甘寒质滑清利，善清热利尿通淋。两药相须为用，清热利尿通淋力强，故为君药。萹蓄苦泄降燥，微寒能清，善清热利尿通淋；瞿麦（BD错）苦寒泄降清利，善利尿通淋；滑石（A错）甘寒滑利清解，善清热利尿通淋。三药相须为用，清利通淋之力强，以助君药，故为臣药。大黄（C错）苦寒沉降，清泄通利，既泻热通肠、化瘀止痛，又兼利小便；栀子苦寒降泄清利，既清热泻火凉血，又利尿滑肠；灯心草甘淡渗利，微寒能清，善清热利尿通淋。三药相合，既助君臣药利尿通淋，又通便化瘀止痛，故为佐药。甘草甘补和缓，平而偏凉，既和药缓急，又清热解毒，故为使药。全方配伍，苦寒清泄通利，共奏清热、利尿、通淋之功，故善治湿热下注所致的热淋涩痛等。